成人每次刷牙牙膏用量为
A. 大约1g、长度约1cm
B. 大约1g、长度约2cm
C. 大约2g、长度约1cm
D. 大约2g、长度约2cm
E. 大约3g、长度约2cm

正确答案：A。大约1g、长度约1cm

解析：成人每次刷牙只需用大约1g（长度约1cm）的膏体即可。掌握“自我口腔保健方法”知识点。